交叉十字绷带在缠绕时应注意的是
A. 在患侧耳周垫以棉垫或纱布
B. 短绷带或纱布条打结收紧，以裸露健眼
C. 不要压迫耳根及影响呼吸
D. 将绷带中份置于鼻部覆盖，并于鼻孔处剪洞以利呼吸
E. 绷带中份包入纱布数块，使之卷成圈柱状，使用时其将置于创口外区

正确答案：C。不要压迫耳根及影响呼吸

解析：交叉十字绷带（亦称环绕法）：交叉十字绷带亦称环绕法，被广泛用于颌面部（例如耳前区、耳后区、腮腺区、下颌下区、颏下区）和上颈部术后和损伤的包扎固定。缠绕时应注意不要压迫耳根及影响呼吸。掌握“口外创口处理”知识点。